6个月婴儿。喘憋3天，低热伴有咳嗽，精神食欲尚可。查体：呼气性呼吸困难，双肺闻及哮鸣音，可见轻度三凹征和鼻翼扇动。胸部X线片显示不同程度肺气肿和支气管周围炎，化验血WBC7.1×10⁹/L，淋巴细胞56％，中性粒细胞41％，正确的诊断是
A. 支气管肺炎
B. 毛细支气管炎
C. 肺炎支原体肺炎
D. 葡萄球菌肺炎
E. 革兰阴性杆菌肺炎

正确答案：B。毛细支气管炎